患者，女，35岁，临床诊断为高甘油三酯，给予非诺贝特微粒型胶囊治疗，正确的用法用量为
A. 0.1gtid
B. 0.2gqd
C. 0.5gtid
D. 0.5gqd
E. 0.8gtid

正确答案：B。0.2gqd

解析：本题考查非诺贝特的使用。微粒型的非诺贝特用法用量是0.2g，qd（B对）。